社会道德情感加深、自尊感形成萌芽的时期是
A. 婴儿期
B. 幼儿期
C. 学龄前期
D. 学龄期
E. 青春期

正确答案：C。学龄前期